患者，女，32岁，一天前发热，体温39.8C，全身乏力，四肢疼痛，近日有流感患者接触史。查体见咽部轻度充血，血常规检查白细胞计数偏低，中性粒细胞比例低，该患者最适宜选用的药物是
A. 利巴韦林片
B. 奥司他韦胶囊
C. 阿昔洛韦片
D. 金刚烷胺片
E. 齐多夫定片

正确答案：B。奥司他韦胶囊

解析：本题考查奥司他韦。患者出现题干症状，最适宜选用的药物是奥司他韦胶囊（B对）。该患者全身乏力，四肢疼痛，近日有流感患者接触史，应首选应用奥司他韦胶囊进行抗流感治疗。利巴韦林（A错）用于呼吸道合胞病毒引起的病毒性肺炎与支气管炎，皮肤疱疹病毒感染等。阿昔洛韦（C错）用于生殖器疱疹病毒感染初发和复发单纯疱疹病毒感染病例，对反复发作病例口服本品用作预防。金刚烷胺片（D错）用于帕金森病、帕金森综合征、药物诱发的锥体外系疾患，一氧化碳中毒后帕金森综合征及老年人合并有脑动脉硬化的帕金森综合征，也用于防治A型流感病毒所引起的呼吸道感染。齐多夫定（E错）用于治疗人类免疫缺陷病毒（HIV）感染。